哪种情绪对人的生理功能起良好的作用，可以提高人的活动能力，充实体力和精力，发挥潜在能力，有利于人体健康
A. 愉快、积极
B. 不愉快
C. 消极
D. 强烈
E. 长期强烈

正确答案：A。愉快、积极